某吸烟者，从上个月开始戒烟。按行为改变的阶段模式，他目前处于
A. 准备阶段
B. 打算阶段
C. 维持阶段
D. 无打算阶段
E. 行动阶段

正确答案：E。行动阶段

解析：该吸烟者已经开始了戒烟行为，并持续1个月，结合对行为改变的阶段的划分，他目前处于行动阶段（E对），该阶段将持续6个月。当该吸烟者的戒烟行为持续6个月以上，他处于行为维持阶段（C错）。当该吸烟者有意进行戒烟，并计划半年能开始，他处于打算阶段（B错）。当该吸烟者有意进行戒烟，并打算1个月内就开始戒烟，他处于准备阶段（A错）。若该吸烟者不认可戒烟行为，坚持不打算改变自己的行为，或计划于半年以后再开始戒烟，则他处于无打算阶段（D错）。